患者，女，发作性喉间痰鸣气喘多年，因受寒发作1天，现症见：呼吸急促，喉中哮鸣有声，胸膈满闷如塞，咳不甚，咯吐不爽，痰稀薄色白，面色晦滞带青，口不渴，形寒畏冷，舌苔白滑，脉弦紧。其治疗宜首选的方剂是
A. 定喘汤
B. 射干麻黄汤
C. 苏子降气汤
D. 七味都气丸
E. 小青龙汤

正确答案：B。射干麻黄汤

解析：患者因寒而发作，痰稀薄色白，面色晦滞带青，口不渴，形寒畏冷，舌苔白滑，脉弦紧，诊断为哮喘寒哮证，选方：射干麻黄汤（B对）。热哮证选方定喘汤（A错）。寒哮证哮久阳虚，发作频繁，发时喉中痰鸣如鼾，气短不足以息，咳痰清稀，面色苍白，汗出肢冷，舌淡苔白，脉沉细者，当温阳补虚，降气化痰，用苏子降气汤（C错）。肾虚证用七味都气丸（D错）。